患儿，男，10岁，患麻疹后3天，低热乏力，颌下淋巴结肿大，牙龈疼痛、出血、口腔奇臭，不敢刷牙，检查可见下前牙唇侧牙龈出血，龈缘溃疡。拟诊
A. 牙周炎
B. 疱疹性龈口炎
C. 雪口病
D. 急性坏死性龈炎
E. 带状疱疹

正确答案：D。急性坏死性龈炎

解析：本题考查急性坏死性龈炎的诊断。患儿男，10岁，患麻疹（急性传染病）后3天，低热乏力（重度全身症状），颌下淋巴结肿大，牙龈疼痛、出血、口腔奇臭（组织坏死），不敢刷牙，检查可见下前牙唇侧牙龈出血，龈缘溃疡。上述症状，拟诊为急性坏死性龈炎（D对）。牙周炎（A错）主要是由于牙菌斑中的细菌侵犯牙周组织而引起的慢性炎症，可导致牙周支持组织的破坏，牙周袋形成、附着丧失和牙槽骨的吸收，随着病程进展牙齿慢慢松动，牙龈退缩最终可导致牙齿丧失。疱疹性龈口炎（B错）是一种由单纯疱疹病毒所致的口腔黏膜感染性疾病，以出现簇集性小水疱为特征，有自限性，易复发。雪口病（C错）是由于口腔念珠菌感染引起的口腔黏膜炎症，主要表现为颊黏膜、腭部、舌头表面或者口咽部表面的白色斑片。带状疱疹（E错）是一种影响神经和皮肤的感染性疾病，由水痘-带状疱疹病毒引起，通常发生在身体的一侧，表现为疼痛、沿着周围神经走向成群分布的水疱。